链霉素的主要不良反应是
A. 蛋白尿
B. 球后视神经炎
C. 周围神经炎
D. 肝脏损害
E. 耳毒性

正确答案：E。耳毒性

解析：链霉素属于氨基糖苷类抗生素，为兔热病和鼠疫的首选药，也可用于治疗多重耐药的结核病，亦与青霉素联用治疗草绿色链球菌、溶血性链球菌及肠球菌等引起的心内膜炎，耳毒性发生率高（E对），其次为神经肌肉麻痹，肾毒性少见。磺胺类抗菌药可引起泌尿系统损害，出现蛋白尿（A错）、血尿、疼痛、尿闭等症状。乙胺丁醇为人工合成的抗结核杆菌药，临床可用于各型肺结核和肺外结核，特别适用于经链霉素和异烟肼治疗无效的病人，其安全性高、不良反应发生率低、耐药性产生慢，但连续大量使用2-6个月可产生严重毒性反应，如球后视神经炎（B错）引起的弱视、红绿色盲和视野缩小。抗结核药异烟肼常见的不良反应为周围神经炎（C错），表现为手脚麻木、肌肉震颤和步态不稳等，大剂量可出现头痛、头晕、兴奋和视神经炎，严重时可导致中毒性脑病和精神病。抗结核药异烟肼可利福平易出现肝脏损害（D错），合用应定期检查肝功能。